根据《药品说明书和标签管理规定》，在药品说明书中应列出全部辅料名称的是
A. 处方药
B. 注射剂
C. 获得中药一级保护的中药品种
D. 麻醉药品和第一类精神药品

正确答案：B。注射剂

解析：本题考查药品说明书的编写要求。根据《药品说明书和标签管理规定》，在药品说明书中应列出全部辅料名称的是注射剂（B对）。药品说明书的编写要求：药品说明书对疾病名称、药学专业名词、药品名称、临床检验名称和结果的表述，应当采用国家统一颁布或规范的专用词汇，度量衡单位应当符合国家标准的规定。药品说明书应当列出全部活性成分或者组方中的全部中药药味。注射剂和非处方药还应当列出所用的全部辅料名称。药品处方中含有可能引起严重不良反应的成分或者辅料的，应当予以说明。